用于治疗多形性胶质母细胞瘤的药物是
A. 环磷酰胺
B. 塞替派
C. 替莫唑胺
D. 奥沙利铂
E. 丝裂霉素

正确答案：C。替莫唑胺

解析：本题考查替莫唑胺的应用。替莫唑胺（C对）主要用于多形性胶质母细胞瘤。